记录全口义齿颌位关系时，关于（牙合）托的错误说法是
A. （牙合）托是由基托和蜡堤组成
B. 基托有暂基托和恒基托之分
C. 用基托蜡片做的基托称为暂基托
D. 用自凝塑料做的基托称为恒基托
E. 暂基托最后为加热成型塑料所代替

正确答案：D。用自凝塑料做的基托称为恒基托

解析：本题考查（牙合）托。恒基托是最终义齿的一部分，不被替换，故用热凝塑料而不是自凝塑料制作（D错，为本题的正确答案）。（牙合）托是记录全口义齿颌位关系的重要工具。（牙合）托由基托和蜡堤两部分组成（A对），基托部分相当于义齿的基托，用于承载（牙合）堤；蜡堤是用于恢复垂直距离。根据基托的用途将基托分为暂基托和恒基托（B对）。暂基托只用于制作（牙合）托，排列人工牙和形成义齿基托蜡型，最后为加热成型塑料所代替（E对），故一般用基托蜡片制作（C对）。